《母婴保健法》规定，对于依法接受终止妊娠或者结扎手术的，应当给予
A. 有偿服务
B. 免费服务
C. 酌情收费服务
D. 酌情减半收费服务
E. 酌情免费服务

正确答案：B。免费服务